夏季病毒性脑炎的常见病因是
A. 外感寒湿
B. 外感湿热
C. 感受温热毒邪
D. 饮食不洁
E. 感受暑湿

正确答案：C。感受温热毒邪

解析：病毒性脑炎是由多种病毒感染引起的脑实质的炎症，以发热、头痛、呕吐、意识障碍或精神异常为主要临床表现，中医病因主要是因感受温热毒邪（C对）。包括风热、暑热、燥热毒邪等。暑热之邪属于温热毒邪，因其常兼夹湿邪，可形成暑湿之证，选项感受暑湿（E错）为常见病因中的一方面，表述不全。